胃溃疡最主要的症状是
A. 嗳气、反酸
B. 恶心、呕吐
C. 呕吐、黑便
D. 上腹疼痛
E. 食欲减退

正确答案：D。上腹疼痛

解析：胃溃疡的主要症状是上腹疼痛或不适（D对）。嗳气、反酸（A错）、恶心、呕吐（B错）、食欲减退（E错）为慢性胃炎的表现。呕吐、黑便（C错）为上消化道出血的表现。